下列关于肋间神经的叙述，错误的是
A. 共11对
B. 位于相应肋间隙中
C. 第2肋间神经的外侧皮支走向上臂内侧称肋间臂神经
D. 肌支仅支配肋间肌
E. 无

正确答案：D。肌支仅支配肋间肌

解析：肋间神经共11对（A对），均位于相应的肋间隙中（B对）。上6对肋间神经的肌支支配肋间肌、上后锯肌和胸横肌；下5对肋间神经的肌支支配肋间肌和腹前外侧壁肌群（D错，为本题正确答案）。另外，第2肋间神经的外侧皮支走向上臂内侧与臂内侧皮神经交通，故称肋间臂神经（C对）。